患儿，男，9岁。发作性惊厥3年，发时全身肢体抽搐，双目上视，神志不清，止后如常舌苔白，脉弦，诊断为风痫。治疗首选
A. 涤痰汤
B. 河车八味丸
C. 医痛丸
D. 定痫丸
E. 通窍活血汤

正确答案：D。定痫丸

解析：本证多由惊风反复发作，风邪与伏痰相搏，进而阻塞心窍，扰乱神明，横窜经络，因而全身肢体抽搐，双目上视，神志不清。舌苔白，脉弦为风痰内盛之征，宜用具有息风定痫功效的定痫丸（D对）；涤痰汤具有涤痰开窍功效，用于治疗痰痫，症见发作时痰涎壅盛，喉间痰鸣，神志恍惚，状如痴呆，或为失神，瞪目直视，或仆倒于地，手足抽搐不甚明显，肢体麻木、疼痛，骤发骤止，舌苔白腻，脉滑（A错）；河车八味丸具有补益脾肾之功效，用于治疗癫痫中的脾虚两虚证，症见发病年久，屡发不止，瘛疭抖动，时有眩晕，智力迟钝，腰膝酸软，神疲乏力，少气懒言，四肢不温，睡眠不宁，大便稀溏，舌淡红，苔白，脉沉细无力（B错）；医痫丸具有祛风化痰，定痫止搐的功效，用于诸痫时发，二目上窜，口吐涎沫，抽搐昏迷（C错）；定痫丸具有息风定痫的功效，用于治疗风痫，症见发作时突然仆倒，神志丧失，继而抽搐，颈项及全身强直，两目窜视，牙关紧闭，口吐白沫，口唇及面部色青，舌苔白，脉弦滑（D错）；通窍活血汤具有活血化瘀，通窍息风的功效，用于治疗瘀血痫，症见发作时头晕眩仆，神识不清，四肢抽搐，抽搐部位较为固定，头痛，消瘦，大便干硬如羊矢，舌红少苔或见瘀点，脉涩，指纹沉滞（E错）。